妊娠足月，腹痛或作或止，出血少许，腰不痛者是
A. 临产
B. 试胎
C. 弄胎
D. 分娩
E. 以上均非

正确答案：C。弄胎

解析：临月腹痛腰不痛，或作或止名弄胎（C对）。临产是指产妇已进入产程。主要标志为:有规律并且逐渐增强的宫缩，持续30秒或以上，间歇5-6分钟，同时伴随进行性宫颈管消失、宫口扩张和胎先露部下降，用镇静药物不能抑制（A错）。月数未足腹中痛，痛定如常名试胎（B错）。分娩是指成熟胎儿和胎衣从母体全部娩出的过程（D错）。